导致物质相关障碍的精神活性物质主要包括7大类，下列不属于的是
A. 中枢神经系统抑制剂
B. 中枢神经系统兴奋剂
C. 致幻剂
D. 烟草
E. 非挥发性溶剂

正确答案：E。非挥发性溶剂

解析：导致物质相关障碍的精神活性物质主要包括：①中枢神经系统抑制剂（A对）；②中枢神经系统兴奋剂（B对）；③大麻；④致幻剂（C对）；⑤阿片类；⑥挥发性溶剂；⑦烟草（D对）。非挥发性溶剂（E错，为本题正确答案）不是导致物质相关障碍的精神活性物质。